下列哪种病变可引起喷射性呕吐
A. 脑膜炎
B. 胆囊炎
C. 肠梗阻
D. 尿毒症
E. 前庭器官疾病

正确答案：A。脑膜炎

解析：脑膜炎可能导致颅内高压，从而引起喷射性呕吐（A对），尿毒症一般不会引起颅内高压，但呕吐时可能会伴有腹痛等症状（D错）。前庭器官疾病（E错）引起的呕吐为前庭障碍性呕吐，呕吐时，伴有皮肤苍白、血压下降、心动过缓等特点。胆囊炎（B错）、肠梗阻（C错）引起的呕吐为反射性呕吐，特点是有恶心先兆，但是呕吐后不觉轻松。